哪一种作业可出现肢端溶骨症
A. 氢氰酸作业工人
B. 硫化氢作业工人
C. 氯乙烯作业中的清釜工
D. 二硫化碳作业工人
E. 四氯化碳作业工人

正确答案：C。氯乙烯作业中的清釜工